淡红色处方作为
A. 普通处方
B. 急诊处方
C. 儿科处方
D. 麻醉药品和第一类精神处方
E. 第二类精神药品处方

正确答案：D。麻醉药品和第一类精神处方

解析：本题考查处方。麻醉药品和第一类精神药品处方（D对）印刷用纸为淡红色。普通处方（A错）的印刷用纸为白色。急诊处方（B错）印刷用纸为淡黄色。儿科处方（C错）印刷用纸为淡绿色。第二类精神药品处方（E错）印刷用纸为白色。